按照牙体缺损由小到大的程度，牙体缺损程度最大时应选用
A. 全冠
B. 嵌体
C. 桩冠
D. 部分冠
E. 高嵌体

正确答案：C。桩冠

解析：本题考查桩核冠。桩核冠利用插入根管内的桩来固位，利用摩擦力和粘固力、粘接力与根管内壁之间的力获得固位，进而为核为全冠提供固位的修复体（C对）。牙体缺损较小时可用嵌体修复（BE错）。全冠可恢复缺失牙的形态和功能，但需要有足够的牙体组织固位（A错）。部分冠是覆盖于部分牙冠表面的固定修复体，当非嵌体和充填适应症时，牙体各部位的各个径较大时可选用部分冠，不能用于修复较大程度的牙体缺损（D错）。